牙周炎时最常见的牙槽骨吸收方式是
A. 水平型牙槽骨吸收
B. 垂直型牙槽骨吸收
C. 凹坑状牙槽骨吸收
D. 反波浪型牙槽骨吸收
E. 扶壁骨形成

正确答案：A。水平型牙槽骨吸收

解析：本题考查牙槽骨破坏的形式。牙周炎时最常见的牙槽骨吸收方式是水平型牙槽骨吸收（A对）。即牙槽间隔、唇颊侧或舌侧的嵴顶边缘呈水平吸收，而使牙槽嵴高度降低，通常形成骨上袋。垂直型牙槽骨吸收指牙槽骨发生垂直方向或斜形吸收，与牙根面之间形成一定角度的骨缺损，牙槽嵴的高度降低不多，而牙根周围的骨吸收较多。垂直性骨吸收（B错）不如水平型骨吸收常见。凹坑状牙槽骨吸收（C错）指牙槽间隔的骨嵴顶吸收，其中与龈谷相应的部分破坏迅速，而颊舌侧骨质仍保留，形成弹坑状或火山口状缺损。此种吸收集中于后牙较少见。当牙间骨骼破坏而下凹，而颊舌面骨嵴未吸收时，使骨嵴呈现反波浪型牙槽骨吸收（D错），也不是最常见的骨吸收方式。扶壁骨形成（E错）属于牙槽骨代偿增生，不是牙槽骨吸收方式。